邪盛病进时，常见的脉象是
A. 实
B. 大
C. 紧
D. 滑
E. 长

正确答案：B。大

解析：大脉脉象特征：脉体宽大，但无脉来汹涌之势。疾病中若脉大，则提示病情加重，故《素问·脉要精微论》说：“大则病进”（B对）。实脉多见于实证，也见于正常人（A错）。紧脉绷急弹指，状如牵绳转索。常见于实寒证，疼痛和食积等（C错）。滑脉往来流利，应指圆滑，如盘走珠。多见于痰湿、食积和实热等证。亦是青壮年的常脉，妇女的孕脉（D错）。长脉首尾端直，超过本位。常见于阳证、热证、实证，亦见于平人（E错）。